直肠全长有骶曲和会阴曲，其弯曲的方向为
A. 骶曲凸向后，会阴曲凸向前
B. 骶曲凸向前，会阴曲凸向后
C. 骶曲凸向前，会阴曲凸向前
D. 骶曲凸向后，会阴曲凸向后
E. 以上都错

正确答案：A。骶曲凸向后，会阴曲凸向前

解析：骶曲为凸向后方的弓形弯曲(BC错)，而会阴曲为凸向前方的弓形弯曲(A对D错)。